损伤后出现同侧面部痛温觉丧失
A. 薄束和楔束
B. 脊髓丘脑侧束
C. 三叉神经脊束
D. 三叉丘系
E. 无

正确答案：C。三叉神经脊束

解析：三叉神经中传导头面部皮肤、口鼻黏膜痛温觉的纤维入脑后下降为三叉神经脊束，止于三叉神经脊束核，后者发出纤维交叉到对侧，组成三叉丘脑束，止于背侧丘脑的腹后内侧核。三叉神经脊束（C对）损伤后使同侧面部痛温觉传入障碍，出现同侧面部痛温觉丧失。薄束和楔束（A错）损伤后出现同侧本体感觉、精细触觉丧失。脊髓丘脑侧束（B错）损伤后出现损伤平面1-2节段以下的对侧肢体痛温觉丧失。三叉丘系（D错）即三叉丘脑束，损伤后出现对侧面部痛温觉、触压觉丧失。